苯甲酸用作中药合剂的抑菌剂，其用量不得过
A. 0.003
B. 0.005
C. 0.0003
D. 0.0005
E. 0.001

正确答案：A。0.003

解析：本题考查的是合剂的质量要求。苯甲酸用作中药合剂的抑菌剂，其用量不得过0.30%（A对）。合剂系指中药饮片用水或其他溶剂，采用适宜的方法提取、制成的口服液体制剂，其中单剂量灌装者也可称为口服液。合剂可以根据需要加入适宜的附加剂。如需加入抑菌剂，除另有规定外，在制剂确定处方时，该处方的抑菌效力应符合《中国药典》抑菌效力检查法的规定，山梨酸和苯甲酸的用量不得超过0.3%（其钾盐、钠盐的用量分别按酸计），羟苯酯类的用量不得超过0.05%（D错），如加入其他附加剂，其品种与用量应符合国家标准的有关规定，不影响成品的稳定性，并应避免对检验产生干扰。必要时可加入适量的乙醇。合剂若加蔗糖，除另有规定外，含糖量一般不高于20%（g/ml）。除另有规定外，合剂应澄清。在贮存期间不得有发霉、酸败、异物、变色、产生气体或其他变质现象，允许有少量摇之易散的沉淀。pH、相对密度、装量及微生物限度应符合规定。除另有规定外，合剂应密封，置阴凉处贮存。